甘露醇溶液冲洗用于
A. 颅内压升高与青光眼
B. 妊娠高血压
C. 急性皮炎
D. 经尿道行前列腺切除术
E. 慢性胆囊炎

正确答案：D。经尿道行前列腺切除术

解析：本题考查剂型与疗效。药物剂型不同，作用也不同。甘露醇注射液静脉滴注可用于各种原因引起的脑水肿，颅内高压和青光眼；作为冲洗器，则应用于经尿道做前列腺切除术（D对）。